支气管肺癌由原发癌肿引起的症状是
A. 霍纳综合征
B. 咳嗽、咯血、胸闷、气急
C. 吞咽困难
D. 头痛、呕吐、共济失调
E. 厌食、肝区疼痛、黄疽

正确答案：B。咳嗽、咯血、胸闷、气急

解析：支气管肺癌临床表现包括原发癌肿引起的症状和体征、肺外胸内扩展引起的症状和体征以、胸外转移引起的症状和和胸外表现。由原发癌肿引起的症状包括咳嗽、痰血或咯血、气短或喘鸣、胸闷、发热、体重下降等（B对）。霍纳综合征（A错）、吞咽困难（C错）为肺外胸内扩展引起的症状和体征。头痛、呕吐、共济失调（D错）为胸外转移至中枢神经系统的症状和体征。厌食、肝区疼痛、黄疽（E错）为肺癌转移至肝脏的表现。